顿咳初期治疗原则是
A. 疏风宣肺
B. 清肺解表止咳化痰
C. 宣肺止咳化痰
D. 解表宣肺止咳化痰
E. 清肺化痰

正确答案：A。疏风宣肺

解析：顿咳主要病机为痰气交阻，肺气上逆，故其治法重在化痰清火、泻肺降逆。初咳期以辛温散寒宣肺、疏风清热宜肺为治法（A对）。小儿肺热咳喘的治疗原则是清肺解表止咳化痰（B错）。咳嗽气喘，痰多胸闷应.宣肺止咳化痰（C错）。外邪犯肺应解表宣肺止咳化痰（D错）。风热夹痰者应清肺化痰（E错）。